下列哪项是固本止崩汤的组成药物
A. 人参、黄苗、白术、熟地、当归、干姜
B. 人参、黄芪、白术、熟地、当归、生姜
C. 人参、黄芪、白术、生地、当归、干姜
D. 人参、黄芪、白术、熟地、当归、黑姜
E. 人参、黄芪、白术、生地、当归、黑姜

正确答案：D。人参、黄芪、白术、熟地、当归、黑姜

解析：固本止崩汤适用于妇人虚火血崩，两目黑暗，昏晕在地。其组成药物为熟地、白术、黄芪、当归、黑姜、人参（D对）。